具有聪耳明目功效的药物是
A. 朱砂
B. 磁石
C. 二者均是
D. 二者均不是

正确答案：B。磁石

解析：本题考查的是朱砂与磁石的功效。具有聪耳明目功效的药物是磁石（B对）。磁石：【功效】镇惊安神，平肝潜阳，聪耳明目，纳气平喘。朱砂（A错）：【功效】镇心安神，清热解毒。